由于孕妇感染了梅毒螺旋体造成的切牙的牙胚发育缺陷，以至于牙齿形态畸形，称为
A. 牛牙样牙
B. 弯曲牙
C. 牙外突
D. 鹰爪尖
E. 哈钦森牙

正确答案：E。哈钦森牙

解析：先天性梅毒牙是由于梅毒螺旋体感染牙胚，侵犯成釉器使釉质发育障碍，在恒切牙、第一恒磨牙釉质产生特征性的发育不全改变。病变切牙称哈钦森切牙。掌握“氟牙症、先天性梅毒牙与牙本质形成缺陷”知识点。